某男，18岁，平日饮食不讲卫生，今晨突发阵发性上腹剧烈绞痛，有向上感，伴恶心，呕吐。而在间歇期却似如常人。査验黄便有蛔虫卵。西医诊断胆道蛔虫症，中医诊为厥，宜选用的药是
A. 椿皮
B. 乌梅
C. 木瓜
D. 地肤子
E. 蛇床子

正确答案：B。乌梅

解析：本题考查的是乌梅的功效。西医诊断胆道蛔虫症，中医诊为厥，宜选用的药是乌梅（B对）。乌梅：【功效】敛肺，涩肠，生津，安蛔，止血。椿皮（A错）：【功效】清热燥湿，涩肠，止血，止带，杀虫。木瓜（C错）：【功效】舒筋活络，化湿和中，生津开胃。地肤子（D错）：【功效】利尿通淋，祛风止痒。蛇床子（E错）：【功效】燥湿祛风，杀虫止痒，温肾壮阳。